患者，女，55岁，诊断为类风湿性关节炎，既往有十二指肠溃疡病史。医生给予甲氨蝶呤+柳氮磺吡啶治疗。甲氨蝶呤用法用量正确的是
A. 75mg，qd
B. 7.5mg，tid
C. 7.5mg，qod
D. 7.5mg，qw
E. 7.5mg，qn

正确答案：D。7.5mg，qw

解析：本题考查药物的使用。甲氨蝶呤可用于治疗类风湿关节炎，口服、肌注或静注均有效，多采用每周1次给药，常用剂量为7.5～25mg/w（D对）。